属于钙拮抗剂的是
A. 硝苯地平
B. 卡托普利
C. 哌唑嗪
D. 可乐定
E. 利血平

正确答案：A。硝苯地平

解析：本题考查钙拮抗剂。硝苯地平（A对）为钙离子通道阻滞剂，通过抑制钙离子内流，松弛血管平滑肌，扩张血管，临床适用于预防和治疗冠心病心绞痛。卡托普利（B错）为血管紧张素转化酶抑制剂。哌唑嗪（C错）为选择性突触后α₁受体阻滞药。可乐定（D错）刺激脑干α₂-肾上腺受体，导致交感神经从中枢神经系统的传出减少，从而使外周阻力、肾血管阻力、心率以及血压降低。利血平（E错）是肾上腺素能神经元阻断性抗高血压药。